下列哪项不是原发性肝癌的致癌因素
A. 病毒性肝炎
B. 家族史及遗传因素
C. 黄曲霉污染食物
D. 肝硬化
E. 胆道感染

正确答案：E。胆道感染

解析：原发性肝癌是指由肝细胞或肝内胆管上皮细胞发生的恶性肿瘤，其病因与发病机制包括：①病毒性肝炎（A对）、肝硬化（D对）；②家族史及遗传因素（B对）；③长期进食黄曲霉污染食物（C对）；④毒物与寄生虫如血吸虫、华支睾吸虫。胆道感染（E错，为本题正确答案）主要引起胆囊炎，与原发性肝癌关系不大。